《处方药与非处方药分类管理办法（试行）》将非处方药分为甲乙两类，分类主要是根据药品的
A. 方便性
B. 普及性
C. 有效性
D. 经济性
E. 安全性

正确答案：E。安全性

解析：本题考查的是非处方药的分类。《处方药与非处方药分类管理办法（试行）》将非处方药分为甲乙两类，分类主要是根据药品的安全性（E对）。非处方药的分类：国家根据药品的安全性，非处方药又被分为甲、乙两类，就用药安全性而言，乙类非处方药相对于甲类非处方药更安全。